具有祛风湿，利水消肿功效的药物是
A. 独活
B. 川乌
C. 防己
D. 桑寄生
E. 络石藤

正确答案：C。防己

解析：防己辛能行散，苦寒降泄，能祛风除湿止痛，又能清热；且本品苦寒降泄，能清热利水，善走下行而泄下焦膀胱湿热，尤宜于下肢水肿，小便不利者（C对）；独活（A错）、川乌（B错）、桑寄生（D错）都有祛风湿的功效，但三者都不能利水消肿；络石藤能祛风湿，也能消肿，但络石藤是通过凉血而消肿，而不是利水消肿（E错）。